关于倒位的描述正确的是
A. 染色体只发生一次断裂
B. 染色体两臂均断裂断片互换
C. 染色体旋转180度
D. 以上都不对

正确答案：D。以上都不对

解析：本题考查倒位。倒位是指染色体两次断裂后中间节段倒转180°再重接（D对ABC错）。如颠倒的片段包括着丝点，称为臂间倒位，如不包括着丝点则称为臂内倒位。